疾病的地区分布特征主要与下列哪些因素有关
A. 地形地貌
B. 风俗习惯
C. 经济水平
D. 气象条件
E. 以上均是

正确答案：E。以上均是